既有第一信使特征，也有第二信使特征的信使分子是
A. 钙离子
B. 神经递质
C. 环磷酸腺苷
D. 一氧化氮
E. 生长因子

正确答案：D。一氧化氮

解析：本题考查受体作用的信号转导。既有第一信使特征，也有第二信使特征的信使分子是一氧化氮（D对）。NO可激活可溶性GC（sGC），升高细胞内cGMP水平，产生松弛血管平滑肌、抑制血小板聚集和参与神经传递等生物效应。NO分子小，脂溶性高，能通过生物膜快速扩散，因此NO具备自分泌和旁分泌的作用。NO生成后不仅能对自身细胞，也能对邻近细胞中的靶分子发生用，发挥细胞或突触的信息传递作用。因此，NO是一种既有第一信使特征，也有第二信使特征的信使分子。钙离子（A错）、环磷酸腺苷（C错）均属于第二信使。生长因子（E错）属于第三信使。